以医院为基础的病例对照研究，最常见的选择偏倚是
A. 入院率偏倚
B. 奈曼偏倚
C. 检出症候偏倚
D. 无应答偏倚
E. 回忆偏倚

正确答案：A。入院率偏倚